子痫发作时孕妇的直接死因是
A. 心脏病
B. 脑出血
C. Ⅲ度胎盘早剥
D. 急性重型肝炎
E. 急性肾衰竭

正确答案：B。脑出血